污染物通过在环境介质中的迁移和转化，对人的危害
A. 都降低
B. 都增加
C. 既可以降低，也可以增加
D. 保持不变
E. 保持不变或降低

正确答案：C。既可以降低，也可以增加

解析：本题考查污染物通过在环境介质中的迁移和转化，对人的危害。污染物通过在环境介质中的迁移和转化，对人的危害既可以降低，也可以增加（C对ABDE错）。